医师经注册后，应当按照以下注册的内容执业
A. 执业范围
B. 执业地点
C. 执业范围，执业类别
D. 执业范围，执业类别，医疗机构
E. 执业范围，执业类别，执业地点

正确答案：E。执业范围，执业类别，执业地点

解析：医师执业条件：医师经注册后，可以在医疗、预防、保健机构中按照注册的执业地点、执业类别、执业范围执业，从事相应的医疗、预防、保健业务。未经医师注册取得执业证书，不得从事医师执业活动。掌握“执医概述及考试和注册”知识点。